异质性检验的目的是
A. 检查各个独立研究的统计学是否存在异质性
B. 检查各个独立研究的结果是否具有可合并性
C. 检查各个独立研究的干预措施是否存在异质性
D. 检查各个独立研究的研究对象临床特征是否存在异质性
E. 检查各个独立研究的方法学是否存在异质性

正确答案：B。检查各个独立研究的结果是否具有可合并性

解析：本题考查异质性检验的目的。异质性检验是对统计量的齐性检验，目的是检查各个独立研究的结果是否具有可合并性（B对ACDE错）。